妊娠期母体心排出量最高时较未孕时增加约
A. 0.2
B. 0.1
C. 0.15
D. 0.25
E. 0.3

正确答案：E。0.3

解析：妊娠期母体心排出量最高时（左侧卧位）较未孕时增加约30%（E对）。心排出量增加是妊娠期循环系统最重要的改变，为子宫、胎盘、乳房提供足够血流供应。临产后在第二产程心排出量也显著增加。本题注意“心排量”与“心脏容量”、“血容量”区别，妊娠末期心脏容量增加约10%（B错），而血容量增加40～45%。